肛门视诊最常用体位
A. 肘膝位
B. 左侧卧位
C. 截石位
D. 蹲位
E. 弯腰前俯位

正确答案：E。弯腰前俯位

解析：弯腰前俯位，即弯腰扶椅位，是指病人向前弯腰，双手扶椅，露出臀部。是普查肛门疾病的常用体位（E对）。肘膝位（A错）是乙状结肠镜检查的常用体位。左侧卧位（B错）是检查肛门直肠疾病及治疗时最常用的体位。截石位（C错）是病人仰卧，两腿放在腿架上，屈髋屈膝，将臀部移至手术台边缘。蹲位（D错）是检查内痔脱出、脱肛和息肉脱出的常用体位。